下列不能作为根管消毒药物的是
A. 氢氧化钙
B. 甲醛甲酚
C. 樟脑酚
D. 木榴油
E. 氧化锌

正确答案：E。氧化锌

解析：本题考查根管消毒药物。下列不能作为根管消毒药物的是氧化锌（E错，为本题的正确答案）。根管充填术中常用根管消毒有根管内封入氢氧化钙制剂（A对）或髓室内放置蘸有甲醛甲酚（B对）、樟脑酚（C对）或木榴油（D对）的不饱和小棉球，氧化锌丁香油糊剂暂封窝洞。实际上在根管预备过程中，超声和化学药物的应用本身就是根管消毒的手段。根管消毒的方法有激光、微波、超声和药物消毒等，其中后者最为常用，即根管封药或诊间封药。过去常用于临床的根管消毒药物是醛酚类制剂，如甲醛甲酚、樟脑对氯酚和樟脑苯酚等，因其细胞毒性作用等原因而较少使用；目前广泛使用的根管消毒药物是氢氧化钙和氯己定。